中国营养学会根据备孕期妇女营养需要提出的膳食指南为
A. 调整孕前体重
B. 选用碘盐
C. 孕前3个月补充叶酸
D. 保持健康生活方式
E. 以上都是

正确答案：E。以上都是